冠心病心绞痛与心肌梗死时胸痛的主要鉴别点是
A. 疼痛的持续时间及对含服硝酸甘油的反应不同
B. 疼痛的部位不同
C. 疼痛性质不同
D. 疼痛的放射部位不同
E. 疼痛时是否伴发恶心

正确答案：A。疼痛的持续时间及对含服硝酸甘油的反应不同

解析：心绞痛发作的时限短，一般持续数分钟至十余分钟，多为3～5分钟，很少超过半小时，舌下含用硝酸甘油能在几分钟内使之缓解（P219）。心肌梗死时胸痛常发生于安静时，程度较重，持续时间长，可达数小时或更长，休息和含用硝酸甘油片多不能缓解（P236）。因此冠心病心绞痛与心肌梗死时胸痛的主要鉴别点是疼痛的持续时间及对含服硝酸甘油的反应不同（A对）。心肌梗死时的胸痛部位（B错）和性质（C错）与心绞痛相同（P236），多位于中下段胸骨后，且呈压榨性或窒息性，仅程度有所不同。心绞痛常放射至左肩左臂内侧，或至颈、咽或下颌部，心肌梗死时胸痛也可放射至下颌、颈部等部位，故不能作为两者主要鉴别点（D错）。心肌梗死时由于迷走神经受坏死心肌刺激和心排量降低、组织灌注不足等可引起频繁的恶心、呕吐。心绞痛是一般无恶心、呕吐症状，但由于恶心为常见的胃肠道症状，特异性不高，因此不能作为两者主要鉴别点（E错）。